牙髓温度测验的注意事项如下，除外
A. 先测对侧同名牙
B. 隔离唾液
C. 冷测可用小冰棒
D. 热测可用热牙胶
E. 置于牙齿咬合面上

正确答案：E。置于牙齿咬合面上

解析：温度测试：正常牙髓对20～50℃接近口温的水不感到疼痛，10～20℃的冷水和50～60℃的热水很少引起疼痛，故以低于10℃为冷刺激，高于60℃为热刺激。牙髓有病变时，对冷热刺激可能表现敏感或迟钝，先测对照牙，再测患牙，无论冷诊法或热诊法，测试部位均应在牙齿的唇面或颊面中1/3处，因该处釉质较完整，引起反应有可比性。掌握“可复性、急慢性牙髓炎”知识点。